手太阴肺经起于
A. 天府
B. 中府
C. 云门
D. 少商
E. 商阳

正确答案：B。中府

解析：肺手太阴之脉，起于中焦中府穴，下络大肠，还循胃口，上膈属肺。从肺系，横出腋下，下循臑内，行少阴、心主之前，下肘中，循臂内上骨下廉，入寸口，上鱼，循鱼际，出大指之端（B对）。